胸脘痞闷，按之则痛，或咳痰黄稠，舌苔黄腻，脉滑数者，治宜选用
A. 小陷胸汤
B. 滚痰丸
C. 二陈汤
D. 贝母瓜蒌散
E. 清金化痰丸

正确答案：A。小陷胸汤

解析：胸脘痞闷，按之则痛，或咳痰黄稠，舌苔黄腻，脉滑数者，诊断为痰热结胸证，治宜选用小陷胸汤（A对）。滚痰丸主治实热老痰证。癫狂昏迷，或惊悸怔忡，或不寐怪梦，或咳喘痰稠，或胸腕痞闷，或眩晕耳鸣，大便秘结，苔黄厚腻，脉滑数有力（B错）。二陈汤主治湿痰证。咳嗽痰多，色白易咯，恶心呕吐，胸膈痞闷，肢体困重，或头眩心悸，舌苔白滑或腻，脉滑（C错）。贝母瓜蒌散主治燥湿咳嗽。咳嗽呛急，咯痰不爽，涩而难出，咽喉干燥哽痛，苔白而干（D错）。清金化痰丸主治热痰壅肺，咳嗽，咯痰黄稠，舌质红，苔黄腻，脉濡数（E错）。